在传染病的暴发调查中，描述疾病分布特征的主要目的是
A. 提供可能暴露地点的线索流行的特殊形式，疾病暴发常常是地区发病率增高的主要原因
B. 查明哪些人具有较大的发病风险
C. 收集相关信息，以便为形成传染源及传播途径的假说提出依据
D. 识别可能引起续发传播的因素
E. 判断续发传播是否已经发生

正确答案：C。收集相关信息，以便为形成传染源及传播途径的假说提出依据

解析：本题考查传染病暴发调查的目的。在暴发调查中，通过描述疾病的时间、人群和地区分布，从而发现高危人群及防制的重点，为疾病的防制提供依据（C对ABDE错），暴发调查还能描述某些因素与疾病之间的关联，以逐步建立病因假设。